牙片可检查的除了
A. 龋损情况
B. 牙齿色泽
C. 髓角位置
D. 牙槽骨情况
E. 根管长短

正确答案：B。牙齿色泽

解析：本题考查牙片的检查内容。无论是牙片，还是CT等影像检查方法都不可能显示牙齿的色泽（B错，为本题的正确答案），这只能用肉眼观察。牙片是采用X线技术获取的图像，显示牙体硬组织为高密度影像，可以看到牙根数量、根管长短（E对）、粗细、根分叉；牙体组织龋损（A对）后密度变低，显示为低密度影像，与周围正常组织对比明显；髓腔形态、髓角的位置（C对），显示为低密度影像；牙槽骨（D对）的密度比牙组织稍低，有一圈围绕牙根的致密骨白线，为固有牙槽骨。